某地土壤中镉的自然本底值为0.1mg/kg，土壤中镉的卫生标准为1.0mg/kg，则该地区土壤镉的环境容量为
A. 1.lmg/kg
B. 1.0mg/kg
C. 0.9mg/kg
D. 0.1mg/kg
E. 0.1mg/kg～1.1mg/kg

正确答案：C。0.9mg/kg

解析：本题考查该地区土壤镉的环境容量。某地土壤中镉的自然本底值为0.1mg/kg，土壤中镉的卫生标准为1.0mg/kg，则该地区土壤镉的环境容量为：1.0mg/kg－0.1mg/kg＝0.9mg/kg（C对ABDE错）。